桂枝的主治病证是
A. 痰饮证
B. 风寒湿痹
C. 虚寒腹痛
D. 阳虚心悸
E. 风寒表虚有汗

正确答案：A、B、C、D、E。痰饮证；风寒湿痹；虚寒腹痛；阳虚心悸；风寒表虚有汗

解析：本题考查的是桂枝的主治病证。桂枝的主治病证是痰饮证（A对）、风寒湿痹（B对）、虚寒腹痛（C对）、阳虚心悸（D对）与风寒表虚有汗（E对）。桂枝：【主治病证】（1）风寒表虚有汗，风寒表实无汗。（2）风寒湿痹，经寒血滞之月经不调、痛经、闭经，癥瘕。（3）胸痹作痛，阳虚心悸。（4）虚寒腹痛。（5）阳虚水肿，痰饮证。